病毒性肝炎的健康教育内容错误的是
A. 危害的严重性
B. 同一餐厅用餐会传染HBV
C. 是可以预防的疾病
D. HAV经粪-口途径传播
E. 接种甲肝疫苗可有效地保护高危人群

正确答案：B。同一餐厅用餐会传染HBV